素有咳喘宿痰，多湿多痰，恼怒或剧烈咳嗽后突然昏厥，喉有痰声，或呕吐涎沫，呼吸气粗，舌苔白腻，脉沉滑。治疗方剂选
A. 导痰汤
B. 顺气导痰汤
C. 六磨汤
D. 滚痰丸
E. 涤痰汤

正确答案：A。导痰汤

解析：根据“突然昏厥”可知病为“厥证”；根据“素有咳喘宿痰，多湿多痰，喉有痰声，或呕吐涎沫，呼吸气粗，舌苔白腻，脉沉滑”可知证型为“痰厥”。体虚湿盛，饮食不节以致气机升降失调，或痰随气升，阻滞神明而发为痰厥，治宜行气豁痰，用导痰汤（A对）。顺气导痰汤功效顺气解郁，化痰醒神，主治痰气郁结证（B错）。六磨汤功效为行气降逆，通便导滞，主治气滞腹胀，胁腹痞满或腹中胀痛（C错）。滚痰丸功效泻火逐痰，主治实热老痰证（D错）。涤痰汤功效涤痰开窍，主治中风痰迷心窍证（E错）。